阴道检查胎头前囟在骨盆左前方，此时的处理方法应是
A. 行剖宫产术
B. 会阴侧切，转正胎头，产钳助娩
C. 静脉滴注缩宫素加速产程进展，经阴道自娩
D. 吸氧同时，静注地西泮（安定）
E. 静注葡萄糖液内加维生素C同时肌注哌替啶（杜冷丁）

正确答案：B。会阴侧切，转正胎头，产钳助娩

解析：初孕妇，妊娠39周（妊娠满37周至不满42足周期间分娩，为足月产），规律宫缩2小时（已进入第一产程），枕右前位（正常胎方位为枕左前和枕右前），胎心良好（正常胎心为110～160次/分）。骨盆外测量正常，B超测胎头双顶径9.3cm（妊娠足月时胎头双顶径平均约9.3cm），羊水平段3.8cm（羊水平段的正常值为＞2cm～＜8cm）。此时宫口全开，表明产妇已进入第二产程。宫缩减弱（子宫收缩乏力容易造成持续性枕后（横）位），肛查发现盆腔后部空虚（枕后位时肛查盆腔后部空虚），阴道检查胎头前囟在骨盆左前方（枕后右位时胎头前囟在骨盆左前方），综合以上的临床表现和体格检查，诊断胎方位为枕后右位，S=+4表明胎头已下降至坐骨棘平面下4cm，此时的处理应为会阴侧切，转正胎头，产钳助娩（B对）。只有当胎头位置较高，疑有头盆不称才行剖宫产术（A错）（P199）。静脉滴注缩宫素加速产程进展，经阴道自娩（C错）、静注葡萄糖液内加维生素C同时肌注哌替啶(杜冷丁）（E错）只适用于第一产程潜伏期（P199）。吸氧同时，静注地西泮(安定）（D错）适用于宫口扩张缓慢及宫颈水肿时，由于患者已进入第二产程（宫口已全开），因此不考虑静注地西泮（P189）。